1和2型糖尿病的主要区别是
A. 发病年龄不同
B. 对胰岛素的敏感性不同
C. 胰岛素基线水平与释放曲线不同
D. 发生酮症酸中毒的倾向不同
E. 是否存在胰岛素抵抗

正确答案：C。胰岛素基线水平与释放曲线不同

解析：1型糖尿病（胰岛素依赖型糖尿病）的胰岛β细胞破坏，导致胰岛素绝对缺乏，胰岛素基线水平低；2型糖尿病（胰岛素抵抗型糖尿病）是由于胰岛素抵抗和β细胞功能缺陷所致，因此体内胰岛素水平正常甚至升高，空腹血浆胰岛素基础值正常、较低或偏高，葡萄糖负荷后血浆胰岛素高峰延迟，因此1和2型糖尿病的主要区别是胰岛素基线水平与释放曲线不同（C对）。1型糖尿病多青少年发病，起病初期需胰岛素治疗，也存在胰岛素抵抗，但较轻，有自发酮症酸中毒倾向，2型糖尿病可发生在任何年龄，但多见于成人，存在胰岛素抵抗，对胰岛素敏感性低，在一定诱因下也可发生酮症酸中毒；可见发病年龄（A错）、对胰岛素的敏感性（B错）、发生酮症酸中毒的倾向（D错）、是否存在胰岛素抵抗（E错）两者均有差异，但都不是主要区别。